患者，女性，25岁。因外伤致右上12左上12缺失半年余，余留牙健康，牙周情况好，唇侧牙槽嵴丰满。下列说法不正确的是
A. 唇侧可不放基托以利美观
B. 可采用前斜方就位，使人工牙与天然牙间龈乳头部位的间隙减小
C. 人工牙排列避免深覆（牙合）
D. 上颌为Kennedy第一类牙列缺损
E. 可在上颌放（牙合）支托

正确答案：D。上颌为Kennedy第一类牙列缺损

解析：本题考查局部义齿类型，肯氏分类及模型观测。根据牙列缺损情况判定为Kennedy第四类牙列缺损（D错，为本题正确答案）。